24岁男性，农民。因畏寒发热起病，伴全身肌肉酸痛，头痛4天，于8月10日入院。入院1天发现皮肤黄染，尿量减少，尿色深黄，查体：结膜充血，巩膜及皮肤中度黄染，皮肤有出血点，浅表淋巴结肿大，肝肋下lcm，压痛（+），脾（-），实验室检查WBC15.4×10⁹/L，N80%，L20%，尿检：尿蛋白（+），颗粒管型，WBC8～15/HP，RBC20～30/HP，BUN24mmol/L，凝集溶解试验阳性。哪种药物治疗为首选药物
A. 庆大霉素
B. 四环素
C. 新诺明
D. 青霉素
E. 头孢曲松

正确答案：D。青霉素

解析：患者起病出现早期中毒综合征，有“三症状”，即畏寒发热、肌肉酸痛、全身乏力，眼结膜充血、腓肠肌压痛、淋巴结肿大、肝大，凝集溶解试验阳性，应诊断为钩端螺旋体病，治疗钩体病首选青霉素（D对）。庆大霉素（A错）适用于青霉素过敏。四环素（B错）不是首选治疗钩体病的药物。新诺明（C错）为磺胺类药物，临床常用于治疗呼吸道、泌尿道感染和伤寒、细胞性痢疾等。头孢曲松（E错）属第三代头孢菌素，具广谱抗菌作用，对多种革兰阳性菌和革兰阴性菌产生的作用。